投射性测验的理论基础是
A. 精神分析理论
B. 行为主义理论
C. 人本主义理论
D. 认知理论
E. 心理生理学理论

正确答案：A。精神分析理论

解析：投射性测验与精神分析的理论有关。该理论认为一个人对一事物的感知、联想或反应有时是由潜意识或内心深处的矛盾冲突所决定的。测验的方法是把一些模糊的云雾状墨迹或无一定意义的图像或不完整的句子呈现给受试者，让受试者根据自己的认知和体验来解释、说明及联想，以诱导出受试者的经验，使他的人格特点能“投射”到这些测验材料上。掌握“心理测验分类及其应用与一般原则”知识点。